肺结核干酪性病灶液化基本X线表现是
A. 钙化
B. 空洞
C. 渗出
D. 增值
E. 纤维化

正确答案：B。空洞

解析：慢性纤维空洞型肺结核：属于继发性肺结核晚期类型。X线表现为单侧或双侧肺上、中部不规则透亮区。空洞壁厚，壁周有大量纤维粘连，使洞壁固定而坚硬。空洞周围有大片渗出和干酪样病变（B对）。亚急性或慢性血行播散型肺结核，病灶可融合，或增殖硬结和钙化，也可纤维化呈索条阴影，甚至部分病灶可形成空洞透亮区（A、E错）。渗出性结核性胸膜炎，多为一侧，液体一般为浆液性，偶可为血性。病程较长，有大量纤维素沉着，引起胸膜肥厚或粘连钙化等。X线所见随积液量、部位以及胸膜粘连增厚情况而有不同变化（C错）。结核球周围常见散在的纤维增殖性病灶，称为“卫星灶”（D错）。